患者，女，29岁。已婚2年一直未孕，既往月经周期26〜28天，行经期4〜6天。现停经45天，突然左下腹撕裂样剧痛，并伴头晕恶心，面色苍白。不应采取的措施是
A. 妊娠试验
B. 腹部叩诊
C. 后穹窿穿刺
D. 立即转院
E. 妇科检查

正确答案：D。立即转院

解析：异位妊娠属急症，需紧急处理，不建议转院，以免耽误治疗时间（D错，为本题正确选项）。异位妊娠检查：腹部检查（B对）妇科检查（E对）辅助检查：妊娠试验（A对）、后穹隆穿刺（C对）。